太乙针灸属于
A. 艾条灸
B. 艾炷灸
C. 温针灸
D. 温灸器灸
E. 药物灸

正确答案：A。艾条灸

解析：太乙针灸是实按灸的一种，而实按灸属于艾条灸（A对）。艾柱灸为艾灸的一种，可分为隔姜灸、隔蒜灸、隔盐灸等（B错）。温针灸为艾灸的一种（C错）。温灸器灸为艾灸的一种（D错）。药物灸即天灸，不属于艾灸（E错）。